在不同药物动力学模型中，计算血药浓度与时间关系涉及不同参数。双室模型中，慢配置速度常数是
A. Km，Vm
B. MRT
C. Kₐ
D. Cl
E. β

正确答案：E。β

解析：本题考查药动学中各参数的意义。β（E对）称为消除速度常数或称为慢配置速度常数；双室模型药物血药浓度与时间的关系为：C=Ae-αt+Be-βt；α为分布速度常数或快配置速度常数；β为消除速度常数或称为慢配置速度常数；Vm是酶饱和的最高反应速度，Km是使反应浓度达到最高速度一半时底物的浓度（A错）；MRT（B错）为药物在体内的平均滞留时间；Kₐ（C错）为吸收速率常数；Cl（D错）为清除率。